某女，50岁。宿患癥块。证属瘀血积滞。治当活血、化瘀、消肿，宜选用的成药是
A. 桂枝茯苓丸
B. 妇科千金片
C. 千金止带丸
D. 益母草胶囊
E. 妇炎平胶囊

正确答案：A。桂枝茯苓丸

解析：本题考查的是桂枝茯苓丸的功能。宿患癥块。证属瘀血积滞。治当活血、化瘀、消肿，宜选用的成药是桂枝茯苓丸（A对）。桂枝茯苓丸：【功能】活血，化瘀，消癥。妇科千金片（B错）：【功能】清热除湿，益气化瘀。千金止带丸（C错）：【功能】健脾补肾，调经止带。益母草胶囊（D错）：【功能】活血调经。妇炎平胶囊（E错）：【功能】清热解毒，燥湿止带，杀虫止痒。